喉上神经支配
A. 茎突舌骨肌
B. 环杓后肌
C. 环甲肌
D. 甲杓肌
E. 环杓侧肌

正确答案：C。环甲肌

解析：喉上神经支配环甲肌（C对）。茎突舌骨肌（A错）由面神经支配。环杓后肌（B错）、甲杓肌（D错）、环杓侧肌（E错）均由喉返神经支配。